某男，34岁。胃痛隐隐，绵绵不休，喜温喜按，劳累，受凉或空腹时疼痛明显，进食后疼痛缓解，时呕清水，神疲纳少，四肢倦怠，手足不温，大便溏薄，舌淡苔白，脉虚弱。医师诊断为胃痛，证属脾胃虚寒，处方如下：炙黄芪9g，桂枝9g，白芍18g，生姜6g，炙甘草9g；大枣6g，饴糖10g，7剂水煎服每日1剂早、午、晚分服。以下有关药师针对处方中白芍饮片的遴选建议，最适合的是
A. 选用盐炒白芍，增强补益作用
B. 选用酒炒白芍，增强止痛作用
C. 选用醋炒白芍，增强止痛作用
D. 选用清炒白芍，缓和寒性
E. 选用土炒白芍，增强止泻作用

正确答案：D。选用清炒白芍，缓和寒性

解析：本题考查的是胃痛的辨证论治。胃痛隐隐，绵绵不休，喜温喜按，劳累，受凉或空腹时疼痛明显，进食后疼痛缓解，时呕清水，神疲纳少，四肢倦怠，手足不温，大便溏薄，舌淡苔白，脉虚弱。医师诊断为胃痛，证属脾胃虚寒，处方如下：炙黄芪9g，桂枝9g，白芍18g，生姜6g，炙甘草9g；大枣6g，饴糖10g，7剂水煎服每日1剂早、午、晚分服。以下有关药师针对处方中白芍饮片的遴选建议，最适合的是选用清炒白芍，缓和寒性（D对）。胃痛脾胃虚寒证：【症状】胃痛隐隐，绵绵不休，喜温喜按，空腹痛甚，得食痛缓，劳累或受凉后发作或加重，时呕清水，神疲纳少，四肢倦怠，手足不温，大便溏薄。舌淡苔白，脉虚弱或迟缓。【方剂应用】基础方剂为：1.基础方剂：黄芪建中汤（炙黄芪、桂枝、生姜、芍药、炙甘草、大枣、饴糖）加减。2.合理用药与用药指导：（1）饮片选择：黄芪建中汤出自东汉《金匮要略》。宜选用清炙黄芪，性偏温，补气之力增强，且有健脾和胃之功，清炙者则补而不腻；选用炒白芍，寒性已缓，长于养血和络，缓脾止痛；饴糖宜选用麦芽糖，补中益气，缓急止痛。（2）剂量建议：原方中芍药用量最大，是桂枝、甘草、生姜剂量的两倍，黄芪仅用一两半，饴糖用一升。（3）煎法服法：水煎温服，每日3次，宜餐前或餐后1小时服用。大枣宜擘开入煎；饴糖不入煎剂，临用时烊化兑服。酒白芍（B错）酸寒之性降低，入血分，善于调经止血，柔肝止痛，用于肝郁血虚，胁痛腹痛，月经不调，四肢挛痛。